常见的周围血管征不包括
A. 枪击音
B. 毛细血管搏动征
C. 脉压增大
D. 水冲脉
E. Duroziez双重杂音

正确答案：C。脉压增大

解析：周围血管征是指在某些疾病条件下检查周围血管时所发现的血管搏动或波形的改变。临床上常见的周围血管征主要见于主动脉瓣关闭不全、甲亢、严重贫血等脉压增大的疾病。周围血管征包括枪击音（A对）、毛细血管搏动征（B对）、水冲脉（D对）、Duroziz双重杂音。脉压增大（C错，为本题正确答案）是周围血管征产生的原因，但本身不属于周围血管征。